医疗机构违反规定，出具虚假证明文件的，对造成危害后果的
A. 1千元以下罚款
B. 3千元以下罚款
C. 5千元以下罚款
D. 8千元以下罚款
E. 吊销《医疗机构执业许可证》

正确答案：A。1千元以下罚款

解析：医疗机构违反规定，出具虚假证明文件的，由县级以上人民政府卫生行政部门予以警告；对造成危害后果的，可以处以1千元以下的罚款；对直接责任人员由所在单位或者上级机关给予行政处分。掌握“医疗机构登记和校验及法律责任”知识点。